患者向药师咨询，停用口服避孕药后多久可备孕。下列答复中，正确的是
A. 复方短效口服避孕药停药6个月后方可备孕
B. 复方短效口服避孕药停药后即可备孕
C. 复方短效口服避孕药停药3个月后方可备孕
D. 长效避孕药停药后即可备孕
E. 长效避孕药停药3个月后方可备孕

正确答案：B。复方短效口服避孕药停药后即可备孕

解析：本题考查避孕药。避孕药对子代的影响：由于复方短效口服避孕药激素含量低，停药后即可妊娠（B对AC错）,不影响子代生长与发育；长效避孕药内含激素成分及剂量与短效避孕药有很大不同，停药6个月后妊娠安全（DE错）。